乙酰胆碱的作用是
A. 抑制心血管、兴奋平滑肌、腺体分泌增加、瞳孔缩小
B. 抑制心血管及平滑肌、腺体分泌增加、瞳孔散大
C. 兴奋心血管、抑制平滑肌、腺体分泌增加、瞳孔缩小
D. 抑制心血管、兴奋平滑肌、腺体分泌减少、瞳孔缩小
E. 兴奋心血管、抑制平滑肌、腺体分泌减少、瞳孔散大

正确答案：A。抑制心血管、兴奋平滑肌、腺体分泌增加、瞳孔缩小

解析：本题考查乙酰胆碱的作用。乙酰胆碱是胆碱能神经递质。按其作用部位可分为两种情况：①毒蕈碱样作用（M样作用），即因兴奋乙酰胆碱M受体，其效应与刺激副交感神经节后纤维所产生的作用类似。如心血管抑制，腺体分泌增加，平滑肌痉挛，瞳孔缩小（A对BCDE错），膀胱及子宫收缩及肛门括约肌松弛等；②烟碱样作用（N样作用），即在自主神经节、肾上腺髓质和横纹肌的运动终板上，乙酰胆碱的N受体受到兴奋，作用与烟碱相似，小剂量兴奋，大剂量抑制、麻痹。